主产地为内蒙古的药材是
A. 白术
B. 甘草
C. 人参
D. 地黄
E. 狗脊

正确答案：B。甘草

解析：本题考查的是常用的道地药材。主产地为内蒙古的药材是甘草（B对）。甘草：【产地】甘草主产于内蒙古、甘肃、新疆等省区，以内蒙古伊盟的杭旗一带、巴盟的橙口及甘肃、宁夏的阿拉善旗一带所产的品质最优，西北其他地区、东北、华北亦产，已有人工栽培。胀果甘草主产于新疆、甘肃、内蒙古等地。光果甘草主产于新疆。白术（A错）：【产地】主产于浙江、安徽、湖南、湖北等省。多为栽培品。人参（C错）：【产地】主产于吉林、辽宁、黑龙江等省，多为栽培品。地黄（D错）：【产地】主产于河南省武陟、温县、博爱等县。狗脊（E错）：【产地】主产与福建、四川等省。